苯丙酮尿症主要的神经系统危害是
A. 智能发育落后
B. 肌痉挛
C. 癫痫小发作
D. 行为落后
E. 多动

正确答案：A。智能发育落后

解析：苯丙酮尿症主要的神经系统危害是智能发育落后（A对）。神经系统危害还有肌痉挛（B错）、癫痫小发作（C错）、多动（E错），但不是神经系统主要的危害。行为落后（D错）很少见。